细胞内液中的主要阴离子是
A. HPO₄²⁻和蛋白质
B. 有机酸
C. HCO₃⁻
D. CL⁻
E. SO₄²⁻

正确答案：A。HPO₄²⁻和蛋白质

解析：细胞内液中的主要阴离子是HPO₄²⁻和蛋白质（A对），其次是HCO₃⁻（C错）、CL⁻（D错）、SO₄²⁻等（E错）。主要阳离子是K⁺，其次是 Na＋、Ca2+、Mg2+。